捏脊疗法的禁忌证是
A. 腹泻
B. 咳喘
C. 遗尿
D. 紫癜
E. 发热

正确答案：D。紫癜

解析：捏脊疗法是通过对督脉和膀胱经的捏拿，调整阴阳、通理经络、调和气血、恢复脏腑功能以防治疾病的一种疗法。临床常用于治疗小儿疳积、消化不良、厌食、腹泻（A错）、呕吐、便秘、咳喘（B错）、夜啼、遗尿（C错）等症。伴有高热、心脏病或有出血倾向者慎用。对于对脊背皮肤感染及有紫癜病患儿禁用此法（D对）。发热（E错）为慎用证。